时行感冒与感冒风热证的区别点，关键在于
A. 恶寒的轻与重
B. 发热的轻与重
C. 咽喉肿痛与否
D. 有无流行性
E. 脉数与否

正确答案：D。有无流行性

解析：“时行感冒，是指在一个时期内广泛流行、病情类似者，多突然起病，恶寒、发热（高热）、周身酸痛、疲乏无力，病情一般较普通感冒为重”，流行性是时行感冒的重要特征，所有的感冒都不具备这一特征，包括风热证（D对）。感冒之风热证，其证候为“身热较著，微恶风，汗泄不畅，头胀痛，面赤，咳嗽，痰黏或黄，或咽喉乳蛾红肿疼痛，鼻塞，喷嚏，流黄浊涕，口干欲饮，苔薄白微黄，舌边尖红，脉浮数”，时行感冒，辨证多属于风热或热毒者，因此两者在恶寒、发热、咽喉肿痛、脉浮数这几方面并无明显差异（ABCE错）。